脑脊液存在于
A. 蛛网膜下隙
B. 硬膜下腔
C. 硬膜外隙
D. 硬脑膜静脉窦
E. 颅内静脉

正确答案：A。蛛网膜下隙

解析：脑室脉络丛产生的脑脊液再汇合第四脑室脉络丛产生的脑脊液一起经第四脑室正中孔和两个外侧孔流入脑和脊髓周围的蛛网膜下隙，然后脑脊液再沿此隙流向大脑背面的蛛网膜下隙（A对），经蛛网膜粒渗透到硬脑膜窦内（主要是上矢状窦），回流入血液中。